《中国药典》2010年看到规定平均重量在1.0～3.0g的栓剂，其重量差异限度为
A. ±5.0%
B. ±7.5%
C. ±10%
D. ±12.5%
E. ±15%

正确答案：B。±7.5%

解析：本题考查栓剂的重量差异限度。栓剂中有效成分的含量，每个均应符合标示量，其重量差异限度如下：平均重量≤1.0g，重量差异限度为±1%；平均重量1.0～3.0g，重量差异限度为±7.5%（B对）；平均重量>3.0g，重量差异限度为±5%。